具有逆转录过程的病毒是
A. 巨细胞病毒
B. 乙型肝炎病毒
C. 人乳头瘤病毒
D. 腺病毒
E. EB病毒

正确答案：B。乙型肝炎病毒

解析：具有逆转录过程的病毒是乙型肝炎病毒（B对），其基因组为不完全闭合dsDNA，复制过程中，在核心颗粒内，以前基因组RNA为模板，在病毒逆转录酶的作用下，逆转录成HBV全长负链DNA，新合成的负链DNA作为模板合成子代正链DNA。